下列各项，属被动体位的是
A. 角弓反张
B. 翻动体位
C. 肢体瘫痪
D. 端坐呼吸
E. 以上均非

正确答案：C。肢体瘫痪

解析：肢体瘫痪（C对）的患者常不能随意调整或变换体位，需别人帮助才能改变体位，故属于被动体位。强迫体位是指患者为减轻痛苦，被迫采取某种特殊的体位，如角弓反张（A错）、翻动体位（B错）、端坐呼吸（D错）。